内毒素血症时
A. 内源性凝血系统被激活
B. 外源性凝血系统被激活
C. 两者均有
D. 两者均无
E. 无

正确答案：C。两者均有

解析：内毒素血症时内源性凝血系统被激活和外源性凝血系统被激活（AB对，C为本题正确答案）。内源性凝血系统被激活是由于凝血因子Ⅻ与胶原、内毒素接触后被激活，FXII被激活为FXIla,接着再激活FXI为FXla,从而启动内源性凝血途径。外源性凝血系统被激活也可在内毒素血症时，大量组织因子释放入血。